关于上颌乳中切牙的解剖特点，下列叙述不正确的是
A. 牙冠短而宽，发育沟明显
B. 舌面隆突、舌窝明显
C. 单根扁而宽，根尖向唇侧弯曲
D. 根长约为冠长的2倍
E. 该牙的解剖标志是宽冠宽根

正确答案：A。牙冠短而宽，发育沟明显

解析：本题考查上颌乳中切牙的解剖特点。牙冠短而宽，发育沟明显（A错，为本题正确答案）不属于上颌乳中切牙的解剖特点。上颌乳中切牙的重要特征是牙冠宽短，但唇面光滑，未见明显发育沟。上颌乳中切牙近中切角似直角，远中切角圆钝，颈嵴明显突起。舌面与唇面大小约相等，近、远中边缘嵴较突，舌隆突显突，舌窝明显（B对）。邻面呈三角形，牙冠颈部很厚，冠根分明。牙根为宽扁单根，根尖偏唇侧（C对）并略偏远中。唇面较舌面宽，根长约为冠长的2倍（D对），宽冠宽根为该牙的重要解剖特征（E对）。